普通处方的用药日数一般不得超过
A. 3日
B. 2日
C. 1日
D. 5日
E. 7日

正确答案：E。7日

解析：急诊处方一般不得超过3日（A错）用量，对于某些慢性病、老年病或特殊情况，处方用量可以适当延长但需医生注明理由，普通处方一般不得超过7日（E对）用量。不超过3日用量的有：一般的急诊处方，一般的其他剂型（除注射剂、控缓释制剂）的麻醉药品和第一类精神药品，门（急）诊为癌症疼痛或中重度慢性疼痛患者开具的注射剂型的麻醉药品和第一类精神药品；不超过7日用量的有：一般的普通处方，第二类精神药品，控缓释制剂型的麻醉药品和第一类精神药品，门（急）诊为癌症疼痛或中重度慢性疼痛患者开具的其他剂型（除注射剂、控缓释制剂）的麻醉药品和第一类精神药品；不超过1日用量（C错）的有：为住院患者开具的麻醉药品和第一类精神药品处方。